颅前窝骨折造成的熊猫眼征指的是
A. 双侧视神经乳头水肿
B. 眶周广泛淤血斑
C. 乳突部皮下淤血斑
D. 双眼视网膜出血
E. 双额部皮肤青紫

正确答案：B。眶周广泛淤血斑

解析：熊猫眼征是指颅前窝骨折出血进入眶内，于眼睑和球结膜下形成广泛性淤血斑（B对）。双侧视神经乳头水肿（A错）为各种原因引起的颅内压增高的常见临床表现。乳突和枕下部皮下淤血斑（C错）即Battle征，为颅后窝骨折的典型表现。视网膜出血（D错）常见于视网膜静脉血栓、糖尿病视网膜病变及高血压视网膜病变等，与颅底骨折无关。双额部皮肤表面淤血（E错）为头皮损伤的临床表现。